链球菌引起的尿路感染，有临床诊断意义的最低菌落计数为
A. 清洁中段尿培养，菌落计数为＜1000个/ml
B. 清洁中段尿培养，菌落计数为1000个/ml
C. 清洁中段尿培养，菌落计数为1万个/ml
D. 清洁中段尿培养，菌落计数为5万个/ml
E. 清洁中段尿培养，菌落计数为10万个/ml

正确答案：B。清洁中段尿培养，菌落计数为1000个/ml

解析：尿液细菌培养和菌落计数对尿路感染的诊断具有重要意义，尿标本最常采用清洁中段尿，链球菌引起的尿路感染,有临床诊断意义的最低菌落数为清洁尿中段培养,菌落计数为1000个/ml.克雷白杆菌引起的尿路感染，有临床诊断意义的最低菌落数为清洁尿中段培养,菌落记数为10万个／ml。（B对）